重度低钾血症或缺钾的病人常有
A. 神经－肌肉的兴奋性升高
B. 心律不齐
C. 胃肠道运动功能亢进
D. 代谢性酸中毒
E. 少尿

正确答案：B。心律不齐

解析：低钾血症时，细胞内钾向钾浓度相对较低细胞外液转移，静息电位负值增大，细胞处于超极化阻滞状态，骨骼肌与胃肠道平滑肌细胞兴奋性降低（A错），胃肠道运动功能减退（C错）。低钾血症时，心肌细胞膜对K＋的通透性下降，因此复极化4期k＋外流减慢，而Na＋内流相对加速，使快反应自律细胞的自动去极化加速，心肌自律性增高而出现心律不齐（B对）。低钾血症细胞外液K＋浓度减少，此时细胞内液K＋外出，而细胞外液H＋内移，引起代谢性碱中毒，而不是代谢性酸中毒（D错）。低钾血症引起肾远曲小管和集合管上皮细胞受损，对ADCH的反应性降低，尿浓缩功能障碍，出现多尿而非少尿（E错）。